当主药可溶于基质时，宜采用
A. 搅拌混合法
B. 乳化法
C. 熔和法
D. 加液研磨法
E. 研和法制备软膏

正确答案：C。熔和法